下颌下腺炎常见的原因是
A. 淋巴结炎
B. 冠周炎
C. 牙槽脓肿
D. 结石阻塞导管
E. 血源性感染

正确答案：D。结石阻塞导管

解析：下颌下腺炎病因：①下颌下腺为混合性腺体，分泌的唾液富含黏蛋白，较腮腺分泌液黏滞，钙的含量也高出2倍，钙盐容易沉积。②下颌下腺导管自下向上走行，腺体分泌液逆重力方向流动，导管长，在口底后部有一弯曲部，导管全程较曲折，这些解剖结构均使唾液易于淤滞，导致涎石形成。掌握“涎石病及下颌下腺炎”知识点。